考虑为寄生虫感染时，水平明显升高的Ig是
A. IgG
B. IgA
C. IgM
D. IgD
E. IgE

正确答案：E。IgE

解析：本题考查各类抗体的特性与功能。考虑为寄生虫感染时，水平明显升高的Ig是IgE（E对）。IgG（A错）是再次免疫应答的产生的主要抗体，是抗感染的“主力军”，可穿过胎盘屏障，在新生儿抗感染免疫中起重要作用。IgA（B错）中的分泌型IgA是外分泌液中的主要抗体类别，参与黏膜局部免疫，在局部黏膜免疫中发挥重要作用，是机体抗感染的“边防军”。IgM（C错）是个体发育过程中最早合成和分泌的抗体，也是初次应答中最早出现的抗体，是机体抗感染的 “先头部队”。IgD（D错）中的膜结合型IgD是B细胞分化发育成熟的标志。